下列病毒中，能引起潜伏感染的是
A. 脊髓灰质炎病毒
B. 麻疹病毒
C. 狂犬病毒
D. 甲型肝炎病毒
E. 水痘－带状疱疹病毒

正确答案：E。水痘－带状疱疹病毒